肋间外肌
A. 起自肋骨上缘
B. 止于肋骨下缘
C. 降肋助呼气
D. 肌纤维斜向内上
E. 肋软骨之间为结缔组织膜

正确答案：E。肋软骨之间为结缔组织膜

解析：肋间外肌起自肋骨下缘，而非肋骨上缘（A错），止于肋骨上缘，而非肋骨下缘（B错），作用是提肋助吸气，而非降肋助呼气（C错），肌纤维斜向前下，而非斜向内上（D错），肋软骨之间为结缔组织膜（E对），即肋间外膜。